根管预备的目的，除外
A. 清除根管内感染物质
B. 扩大根尖孔，以利引流
C. 扩大根管利于根管消毒
D. 减少根管弯曲度
E. 预备根管形态，以利充填

正确答案：B。扩大根尖孔，以利引流

解析：良好的预备应在根尖狭窄处形成根充挡，以防止根充超填；过度预备会破坏根尖孔，若器械穿出，可将细菌和根管内容物推出，导致根尖周组织的急性炎症。根管预备目的：①清理根管内的感染物质和清除根管壁感染的牙本质层，同时有利于根管冲洗液的进入和被溶解物质的溢出；②扩大根管，形成根尖孔向根管方向、内径逐渐增大、有一定锥度的根管形态，预备后的根管应保持根管的原始形态和根尖狭窄区的原始位置；③在近根尖孔处形成根充挡，有利于将根充材料在根管内压紧并限制超填。掌握“根管清理与成形”知识点。